胺碘酮的药理作用有
A. 延长动作电位时程和有效不应期
B. 降低窦房结的自律性
C. 阻滞K⁺通道
D. 加快心房和浦肯野纤维的传导
E. 促进Na⁺、Ca²⁺内流

正确答案：A、B、C。延长动作电位时程和有效不应期；降低窦房结的自律性；阻滞K⁺通道

解析：本题考查胺碘酮。胺碘酮的药理作用：胺碘酮能够延长动作电位时程（A对）、降低窦房结的自律性（B对）、阻滞钾离子通道（C对）、抑制心房和心肌传导纤维的快钠离子流，减慢传导速度（D错）、阻滞心肌细胞Na⁺、Ca²⁺内流（E错）。